下列属于唇周围肌下组的是
A. 笑肌
B. 降口角肌
C. 颧大肌
D. 提上唇肌
E. 提口角肌

正确答案：B。降口角肌

解析：本题考查表情肌、舌腭肌。唇周围肌下组：唇周围肌下组由三块肌肉组成，由浅入深分别为降口角肌（B对）、降下唇肌和颏肌。